正常足月儿配方乳喂养的间隔时间是
A. 0.5小时
B. 1.5小时
C. 2.5小时
D. 3小时
E. 4小时

正确答案：D。3小时

解析：尽早开奶，按需哺乳。正常足月儿配方乳喂养的间隔时间是3小时（D对）。